治疗等渗性脱水理想的液体是
A. 5%碳酸氢钠
B. 等渗盐水
C. 平衡盐溶液
D. 5%葡萄糖
E. 小分子右旋糖酐

正确答案：C。平衡盐溶液

解析：等渗性缺水中的电解质和溶液都是成比例丢失，血清钠仍在正常范围，平衡盐溶液的电解质含量和血浆内含量相仿，因此用来治疗等渗性脱水比较理想（C对）。5％碳酸氢钠（A错）用作治疗酸中毒；5％葡萄糖（D错）溶液为等渗性溶液，但钠离子含量低于血浆，主要用于治疗高渗性脱水；等渗盐水（B错）也可治疗等渗性脱水，但因溶液中的Cl⁻含量比血清Cl⁻含量高，大量输入后有导致血Cl⁻过高，引起高氯性酸中毒的危险，相对平衡盐溶液来说不是最优选择；小分子右旋糖酐（E错）为胶体液，一般用于急性失血性休克的扩容。